以下不能破坏建（牙合）动力平衡的一项是
A. 功能异常
B. 不良口腔习惯
C. 唇裂
D. 龋齿
E. 腭裂

正确答案：D。龋齿

解析：本题考查（牙合）的生长发育。不能破坏建（牙合）动力平衡的一项是龋齿（D错，为本题正确答案）。功能异常（异常吞咽）（A对）、不良口腔习惯（B对）（吐舌习惯）和唇裂（C对）、腭裂（E对）等疾病，可以破坏动力平衡，影响正常的生长发育，造成错（牙合）畸形和不正常的（牙合）关系。